地榆除能凉血止血外，又能
A. 散瘀消痈
B. 解毒敛疮
C. 清热利尿
D. 祛痰止咳
E. 滋阴益肾

正确答案：B。解毒敛疮

解析：本题考查的是地榆的功效。地榆除能凉血止血外，又能解毒敛疮（B对）。地榆：【功效】凉血止血，解毒敛疮。大蓟：【功效】凉血止血，散瘀消痈（A错）。白茅根：【功效】凉血止血，清热生津，利尿（C错）通淋。侧柏叶：【功效】凉血止血，祛痰止咳（D错），生发乌发。墨旱莲：【功效】滋阴益肾（E错），凉血止血。